构成医患信托关系的根本前提是
A. 病人求医行为中包含对医师的信任
B. 病人在医患交往中处于被动地位
C. 医师是“仁者”
D. 现代医学服务是完全可以信赖的
E. 医患交往中加入一些特殊因素

正确答案：A。病人求医行为中包含对医师的信任

解析：本题考查医患关系伦理。医患信托关系是医务人员和医疗机构受患者的信任和委托，保障患者在医疗活动中的健康利益不受损害并有所促进的一种关系。在这种关系中，由于患者的医学知识和能力的缺乏，对医务人员和医疗机构抱着极大的信任而将自己的生命和健康交托给医务人员和医疗机构，所以构成此关系的基本前提是患者对医师的信任（A对）。